甲状腺峡横越气管软骨环的前方
A. 第1-4
B. 第3-5
C. 第2-4
D. 第3-5
E. 第4-5

正确答案：C。第2-4

解析：甲状腺是人体最大的内分泌腺，为红褐色腺体，呈H形，由左、右侧叶和中间的甲状腺峡组成。其中，甲状腺峡位于第2-4 （C对）气管软骨环的前方，连接甲状腺左、右侧叶。